人群分布
A. 森林脑炎见于春天
B. 吸毒、不正当性行为可致艾滋病
C. 城市肺癌发病率和死亡率高于农村
D. 流行性乙型脑炎和脊髓灰质炎多有隐性流行
E. 霍乱可发生大流行

正确答案：B。吸毒、不正当性行为可致艾滋病

解析：本题考查人群分布的特征 。人群的一些固有特征或社会特征可构成疾病或健康状态的人群特征，这些特征包括：年龄、性别、职业、种族和民族、婚姻与家庭、行为生活方式、宗教信仰、人口流动等。吸毒、不正当性行为（B对ACDE错）这些行为生活方式，属于导致疾病的人群分布。